不含高能磷酸键的化合物是
A. 1，3-二磷酸甘油酸
B. 磷酸肌酸
C. 腺苷三磷酸
D. 磷酸烯醇式丙酮酸
E. 1，6-双磷酸果糖

正确答案：E。1，6-双磷酸果糖

解析：高能磷酸键是指水解时释放较大自由能（大于25kJ/mol）的磷酸酯键。1，3-二磷酸甘油酸（A错）、磷酸肌酸（B错）、腺苷三磷酸（ATP）（C错）、磷酸烯醇式丙酮酸（D错）水解均可释放大于25kJ/mol的自由能，为含有高能磷酸键的化合物。1，6-双磷酸果糖（E对）水解释放的自由能小于25kJ/mol，其1、6位的磷酸酯键都不是高能磷酸键。